医患关系是以社会主义法制为保障建立起来的
A. 不平等关系
B. 信托关系
C. 陌生人之间的关系
D. 主从关系
E. 商品关系

正确答案：B。信托关系